强心昔引起的房室传导阻滞最好选用
A. 异丙肾上腺素
B. 氯化钾
C. 肾上腺素
D. 阿托品
E. 苯妥英钠

正确答案：D。阿托品